经胃肠道吸收的药物进入体循环前的降解或失活的过程称为
A. 诱导效应
B. 首过效应
C. 抑制效应
D. 肝肠循环
E. 生物转化

正确答案：B。首过效应

解析：本题考查首过效应。首过效应（B对）是指口服药物在未吸收进入血循环之前，在肠黏膜和肝脏被代谢，而使进入血循环的原形药量减少的现象；酶诱导作用（A错）是指某些化学物质能提高肝药酶的活性，使药物代谢速率加快；酶的抑制效应（C错）是指能抑制肝药酶活性，减慢其它药物的代谢速率；肠-肝循环（D错）是指随胆汁排入十二指肠的药物或其它代谢物，在肠道中又重新被吸收，经门静脉返回肝脏，重新进入血液循环的现象；生物转化（E错）是指药物在机体内经多种酶催化的代谢转化。